患者咳喘10余年，加重半年。咳喘无力，呼多吸少，气不得续，动则益甚，自汗神疲，腰膝痠软，舌淡苔白，脉弱。其证型是
A. 肺气虚
B. 肾气虚
C. 肾不纳气
D. 心肺气虚
E. 肺肾阴虚

正确答案：C。肾不纳气

解析：肺为气之主，司宣发肃降，肾为气之根，主摄纳肺吸人之清气，保证体内外气体的正常交换。患者咳喘久延不愈，累及于肾，致肺肾气虚，则肾不纳气，气不归元，故呼多吸少，气不得续，动则喘息益甚；肾气不足，失其充养，则腰膝酸软乏力；气虚，机能减退，则神疲乏力，宗气不足则声音低怯，卫气不固则自汗；舌淡苔白，脉弱，皆为气虚之象（C对）。